根尖周脓肿与牙周脓肿鉴别的要点如下，除外
A. 牙周袋
B. 脓肿部位
C. 牙髓活力
D. 疼痛程度
E. 牙龈红肿程度

正确答案：E。牙龈红肿程度

解析：本题考查急性根尖周脓肿与急性牙周脓肿的鉴别要点。根尖周脓肿与牙周脓肿鉴别的要点如下，除外牙龈红肿程度（E错，为本题的正确答案）。根尖脓肿和牙周脓肿牙龈都会红肿。从临床检查的角度来看，根尖周脓肿牙体有深龋洞、近髓的非龋疾患和修复体，多无牙髓活力，而牙周脓肿有牙髓活力（C对）。根尖周脓肿无深牙周袋，而牙周脓肿的牙周袋迂回曲折（A对）。根尖周脓肿部位靠近根尖部、中心位于龈颊沟附近，脓肿范围较弥散；而牙周脓肿部位位于较近龈缘，局限于牙周袋壁（B对）。根尖周脓肿疼痛程度重，牙松动度相对较轻、病愈合后牙恢复稳固，叩痛很重；而牙周脓肿疼痛程度相对较轻，牙松动度明显，消肿后仍很松动（D对）。